根据《中华人民共和国药品管理法》，药品经营企业从无许可证企业购进药品。应责令改正，没收违法购进的药品，并处违法购进药品
A. 货值金额五倍以上十五倍以下的罚款
B. 货值金额一倍以上三倍以下的罚款
C. 货值金额二倍以上十倍以下的罚款
D. 货值金额十倍以上三十倍以下的罚款
E. 货值金额二倍以上五倍以下的罚款

正确答案：C。货值金额二倍以上十倍以下的罚款

解析：本题考查从无证生产、经营企业购入药品的法律责任。根据《中华人民共和国药品管理法》，药品经营企业从无许可证企业购进药品货值金额二倍以上十倍以下的罚款（C对）。从无证生产、经营企业购入药品的法律责任：根据《药品管理法》第一百二十九条的规定，药品上市许可持有人、药品生产企业、药品经营企业或者医疗机构未从药品上市许可持有人或者具有药品生产、经营资格的企业购进药品的，责令改正，没收违法购进的药品和违法所得，并处违法购进药品货值金额二倍以上十倍以下的罚款；情节严重的，并处货值金额十倍以上三十倍以下的罚款（D错），吊销药品批准证明文件、药品生产许可证、药品经营许可证或者医疗机构执业许可证；货值金额不足五万元的，按五万元计算。医疗机构向市场销售制剂的法律责任：根据《药品管理法》第一百三十三条规定，医疗机构将其配制的制剂在市场上销售的，责令改正，没收违法销售的制剂和违法所得，并处违法销售制剂货值金额二倍以上五倍以下的罚款（E错）；情节严重的，并处货值金额五倍以上十五倍以下的罚款（A错）；货值金额不足五万元的，按五万元计算。进行虚假宣传的法律责任：进行虚假宣传的，依照《广告法》第五十八条的规定处罚，由市场监督管理部门责令停止发布广告，责令广告主在相应范围内消除影响，处广告费用一倍以上三倍以下的罚款（B错），广告费用无法计算或者明显偏低的，处十万元以上二十万元以下的罚款；情节严重的，处广告费用三倍以上五倍以下的罚款，广告费用无法计算或者明显偏低的，处二十万元以上一百万元以下的罚款，可以吊销营业执照，并由广告审查机关撤销广告审查批准文件、一年内不受理其广告审查申请。构成虚假广告的，依照《广告法》第五十五条的规定处罚，由市场监督管理部门责令停止发布广告，责令广告主在相应范围内消除影响，处广告费用三倍以上五倍以下的罚款，广告费用无法计算或者明显偏低的，处二十万元以上一百万元以下的罚款；两年内有三次以上违法行为或者有其他严重情节的，处广告费用五倍以上十倍以下的罚款，广告费用无法计算或者明显偏低的，处一百万元以上二百万元以下的罚款，可以吊销营业执照，并由广告审查机关撤销广告审查批准文件、一年内不受理其广告审查申请。对于其他发布虚假药品广告的情形，《广告法》及其他法律法规有规定的，依照相关规定处罚，没有规定的，由县级以上市场监督管理部门责令改正；对负有责任的广告主、广告经营者、广告发布者处以违法所得三倍以下罚款，但最高不超过三万元；没有违法所得的，可处一万元以下罚款。